服药期间须大量饮水，防止发生结晶尿的药物是
A. 克林霉素
B. 磺胺甲噁唑
C. 左氧氟沙星
D. 头孢呋辛
E. 米诺环素

正确答案：B。磺胺甲噁唑

解析：本题考查药物的不良反应。磺胺甲噁唑（B对）属于磺胺类药物，应用磺胺类药物期间须大量饮水，防止发生结晶尿。克林霉素（A错）不良反应有肝功能异常、肾功能异常，偶见中性粒细胞减少和嗜酸性粒细胞增多等。左氧氟沙星（C错）属于氟喹诺酮类药物，氟喹诺酮类药物可引起心脏Q-T间期延长等。头孢呋辛（D错）不良反应有消化系统反应（如腹痛、腹泻、恶心、呕吐、食欲减退、口腔溃疡等）、皮肤反应（如皮疹、红斑、瘙痒等）和头痛等。米诺环素（E错）不良反应有休克和过敏反应、自身免疫性肝炎、超敏综合征等。